可确诊流脑的实验室检查是
A. 血常规
B. 脑脊液常规
C. 细菌培养
D. 溶解物实验
E. 抗体检测

正确答案：B。脑脊液常规

解析：脑脊液检查是诊断流脑的重要方法。病初或休克型患者，脑脊液多无改变，应12～24小时后复查。典型的脑膜炎期，压力增高，外观呈浑浊米汤样甚或脓样；白细胞数明显增高至1000×10⁶/L以上，以多核细胞为主；糖及氯化物明显减少，蛋白含量升高（B对）。